患者，女，30岁。烦热干渴，头痛，牙痛，牙龈出血，舌红苔黄而干。治疗应首选
A. 龙胆泻肝汤
B. 泻白散
C. 白虎汤
D. 玉女煎
E. 左金丸

正确答案：D。玉女煎

解析：本题考查常见的病症的辩证、处方。题中患者烦热干渴，头痛，牙痛，牙龈出血，舌红苔黄而干，可辩证为胃热阴虚证。龙胆泻肝汤为清热剂，具有清脏腑热，清泻肝胆实火，清利肝经湿热之功效。主治肝胆实火上炎证。头痛目赤，胁痛，口苦，耳聋，耳肿，舌红苔黄，脉弦细有力；肝经湿热下注证。阴肿，阴痒，筋痿，阴汗，小便淋浊，或妇女带下黄臭等，舌红苔黄腻，脉弦数有力（A错）。泻白散为清热剂，具有清脏腑热，清泻肺热，止咳平喘之功效。主治肺热喘咳。气喘咳嗽，皮肤蒸热，日晡尤甚，舌红苔黄，脉细数（B错）。白虎汤为清热剂，具有清气分热，清热生津之功效。主治气分热盛证，壮热面赤，烦渴引饮，汗出恶热，脉洪大有力（C错）。玉女煎为清热剂，具有清脏腑热，清胃热，滋肾阴之功效。主治胃热阴虚证。头痛，牙痛，齿松牙衄，烦热干渴，舌红苔黄而干。亦治消渴，消谷善饥等（D对）。左金丸为清热剂，具有泻火，疏肝，和胃，止痛之功效。用于肝火犯胃，脘胁疼痛，口苦嘈杂，呕吐酸水，不喜热饮（E错）。